以下结构中，不属于肾髓质的是
A. 肾锥体
B. 肾乳头
C. 肾柱
D. 乳头孔
E. 以上都对

正确答案：C。肾柱

解析：肾髓质由肾锥体构成（A对），肾锥体合并为肾乳头（B对），乳头顶端有许多小孔称乳头孔（D对）。肾柱（C错,为本题正确答案）为伸入肾锥体之间的肾皮质。